女，76岁。脑血管病后遗症患者，左侧肢体偏瘫，行动不便，2周前一次进餐后出现气短，咳嗽后气短逐渐好转，但咳嗽持续存在，近2天来出现发热，咳少量黄痰。查体：左上胸廓轻度塌陷，左上肺叩诊呈浊音，语音共振减弱，呼吸音明显减弱。造成患者上述情况最可能原因是
A. 阻塞性肺炎
B. 肺结核
C. 支气管炎
D. 肺动脉栓塞
E. 气胸

正确答案：A。阻塞性肺炎

解析：患者女性，脑血管后遗症（阻塞性肺炎的常见危险因素），进餐后出现胸闷气短，考虑食物进入气道引起肺炎，咳嗽持续存在，近两天出现发热，咳少量黄痰，表明有感染，根据其临床表现和体征，推测本患者为阻塞性肺炎合并感染的可能性较大（A对）。肺结核（P65）（B错）典型症状为咳嗽、咳痰，痰中带血，常有盗汗乏力症状，本患者无明显结核病症状，因此不作首选。支气管炎（P19）（C错）一般缓慢起病，伴有咳嗽、咳痰、喘息，本患者起病较急且病情较重，左上肺轻度塌陷并且叩诊浊音，不符合支气管炎的典型表现。肺动脉栓塞（P100）（D错）的典型症状一般为胸痛、咳嗽、咯血，不符合本患者的临床表现。气胸（P120）（E错）叩诊一般呈鼓音或过清音，本患者叩诊呈浊音，故不作首选。